某蓄电池厂女工，34岁。以往月经正常，近来月经时常紊乱，经血量过多。采集职业史时应注意询问何种毒物的接触史
A. 镉
B. 铅
C. 锰
D. 汞
E. 砷

正确答案：B。铅

解析：本题考查铅对女性的毒性。铅（B对ACDE错）进入人体后，会对多种系统产生不良影响。女性病人会因为铅中毒导致出现月经失调、不孕不育、流产和早产等特异性症状。